下列含锌最丰富的食物是
A. 鱼贝类
B. 海带
C. 木耳
D. 绿色蔬菜
E. 牛乳及乳制品

正确答案：A。鱼贝类

解析：锌的来源广泛，鱼贝类（A对）海产品、红色肉类及其内脏均为锌的良好来源，海带（B错）主要是含碘，含锌量不及鱼贝类，蛋类、牛乳及乳制品（E错）、谷类胚芽、木耳（C错）等含锌量明显少于鱼贝类。绿色蔬菜（D错）和水果锌含量较低。